喹诺酮类的作用机制是
A. 抑制细菌蛋白质合成
B. 抑制细菌细胞壁合成
C. 与PABA相竞争
D. 抑制二氢叶酸还原酶
E. 抑制DNA回旋酶

正确答案：E。抑制DNA回旋酶

解析：本题考查喹诺酮类药物的作用机制。喹诺酮类的作用机制是抑制DNA回旋酶（E对）。氟喹诺酮类药的主要作用靶位在DNA回旋酶。氨基糖苷类药的抗菌作用机制是抑制细菌蛋白质的合成（A错）。头孢菌素类药物的抗菌作用机制为抑制细菌细胞壁的合成（B错）。磺胺类药与对氨基苯甲酸（PABA）竞争（C错）二氢叶酸合成酶，组织细菌二氢叶酸的合成。甲氧苄啶的作用机制为抑制细菌二氢叶酸还原酶（D错）。